我国国标中规定玉米及玉米制品中黄曲霉毒素B₁的限量是
A. 20μg/kg
B. 15μg/kg
C. 12.5μg/kg
D. 10μg/kg
E. 5μg/kg

正确答案：A。20μg/kg

解析：本题考查我国国标中规定玉米及玉米制品中黄曲霉毒素B₁的限量值。我国国标中规定玉米及玉米制品中黄曲霉毒素B₁的限量是20μg/kg（A对BCDE错）。